布雷迪曾作过这样的实验，两只猴子各坐在自己被约束的椅子上，每隔一定时间通一次电，其中一只（A）猴子能自己断电而避免电击，另一只猴子（B）则不能，最终
A. A得了溃疡病
B. B得了溃疡病
C. AB均得了溃疡病
D. AB均未得病
E. AB均得了高血压

正确答案：A。A得了溃疡病

解析：心理学家布雷迪的猴子实验，是将两只猴子分别缚在两张电椅上，电流每20秒激发一次。其中A猴子电椅上有一压杆，只要在电流袭来之前压一下压杆，两只猴子均可免遭电击：而B猴子电椅上没有压杆。虽然，两只猴子遭受电击的强度和次数并无不同，但是A猴子需要时刻紧张估算电流袭来的时间，结果A猴子得了胃溃疡，B猴子未得病（A对）。这个实验说明了应激会导致消化性溃疡的产生。